骨髓组织炎症性水肿，大量的中性粒细胞浸润，组织溶解坏死，骨髓腔形成脓肿；死骨形成属于以上哪种疾病的病理表现
A. 急性牙髓炎
B. 放射性骨髓炎
C. 牙周炎静止期
D. 急性化脓性骨髓炎
E. 口腔黏膜白斑

正确答案：D。急性化脓性骨髓炎

解析：本题考查急慢性化脓性颌骨骨髓炎。急性化脓性骨髓炎（D对）的病理表现为骨髓组织炎症性水肿，大量的中性粒细胞浸润，组织溶解坏死，骨髓腔形成脓肿；死骨形成。